某患者，戴用全口义齿20年，口腔有黏膜病变，在做新义齿前不需要
A. 停戴旧义齿1周
B. 治疗黏膜病变
C. 检査旧义齿的问题
D. 外科牙槽嵴修整术
E. 使用组织调整剂

正确答案：D。外科牙槽嵴修整术

解析：本题考查全口义齿口腔检查及修复前准备。某患者，戴用全口义齿20年，口腔有黏膜病变，在做新义齿前不需要外科牙槽嵴修整术（D错，为本题正确答案）。患者口腔有黏膜病变，要对症治疗。